白花前胡甲素的结构类型是
A. 蒽醌类
B. 木脂素
C. 二萜类
D. 香豆素类
E. 二氢黄酮类

正确答案：D。香豆素类

解析：本题考查的是前胡的化学成分。白花前胡甲素的结构类型是香豆素（D对）。香豆素是邻羟基桂皮酸的内酯，广泛分布于高等植物中，尤其以芸香科和伞形科为多见，少数发现于动物和微生物中。含香豆素的常用中药有秦皮、前胡、肿节风、补骨脂等。在植物体内，它们往往以游离状态或与糖结合成苷的形式存在。如补骨脂内酯、白芷内酯、花椒内酯、邪蒿内酯等。白花前胡甲素为前胡的主要化学成分。前胡主要化学成分为多种类型的香豆素及其糖苷、三萜糖苷及甾体糖苷、挥发油等。一般以香豆素类成分作为前胡定量质量控制的指标。《中国药典》采用高效液相色谱法测定药材中白花前胡甲素和白花前胡乙素含量，其中白花前胡甲素含量不少于0.90%，白花前胡乙素不少于0.24%。蒽醌类（A错）：蒽醌类成分包括蒽酮及其不同还原程度的产物。主要有大黄素、大黄酚、茜草素、番泻苷等。木脂素（B错）：木脂素类多数是游离的，也有少量与糖结合成苷而存在，由于较广泛地存在于植物的木部和树脂中，或开始析出时呈树脂状，故称木脂素。主要有五味子醇、五味子素、厚朴酚、和厚朴酚、连翘苷等。二萜类（C错）：二萜是指骨架由4个异戊二烯单位构成，含20个碳原子的一类萜类衍生物。绝大多数不能随水蒸气蒸馏。二萜多以树脂、内酯或苷等形式广泛存在于自然界。不少二萜含氧衍生物具有很好的生物活性，如穿心莲内酯、芫花酯、雷公藤内酯、银杏内酯、紫杉醇等。二氢黄酮类（E错）属于黄酮类化合物。黄酮类化合物广泛存在于自然界中，多存在于高等植物及羊齿类植物中。苔类中含有的黄酮类化合物为数不多，而藻类、霉菌、细菌中没有发现黄酮类化合物。如黄芩苷、黄芩素、大豆素、葛根素、芦丁、槲皮素、橙皮苷等。